用银汞合金充填中龋或深龋，需要垫底，是因为银汞合金具有
A. 膨胀性
B. 流动性
C. 传导性
D. 溶解性
E. 变色性

正确答案：C。传导性

解析：本题考查银汞合金的性能-传导性。中龋或深龋牙本质暴露，遇冷热刺激牙髓会出现敏感症状，因此充填时必须用温度的不良导体的修复材料进行充填，银汞合金是热和电的良导体，用其充填必须垫底，以隔绝温度，保护牙髓（C对）。银汞合金充填后体积会收缩（A错）。银汞合金是固体材料无流动性（B错）。银汞合金溶解性（D错）小对牙髓影响小，无变色性（E错）。